男孩，10岁，发热8小时，9月10日入院，入院前曾在外面吃烧烤，体温40℃，呼吸24次/分，血压70/40mmHg，查体:浅昏迷，面色苍白，四肢湿冷，皮肤可见“花斑”，检验:WBC24×10⁹/L，N0.9。最可能考虑的是:
A. 伤寒
B. 中毒性菌痢
C. 乙脑
D. 流脑
E. 疟疾

正确答案：B。中毒性菌痢

解析：青少年男性患者，入院前曾在外面吃烧烤（粪-口传播），体温40℃，呼吸24次/分，血压70/40mmHg，浅昏迷，面色苍白，四肢湿冷，皮肤可见花斑（感染性休克表现），血常规白细胞升高，以中性粒细胞升高为主，结合病史症状体征辅助检查，考虑中毒性菌痢（休克型）（B对）。伤寒（A错）临床特征为持续发热、表情淡漠、相对缓脉、玫瑰皮疹、肝脾肿大和白细胞减少。乙脑（C错）即流行性乙型脑炎，主要通过蚊叮咬而传播。流脑即流行性脑脊髓膜炎（D错），主要经呼吸道传播。疟疾（E错）主要由雌性按蚊叮咬传播，临床上以反复发作的间歇性寒战、高热、继之出大汗后缓解为特点。